下列哪些囊肿属于牙源性颌骨囊肿
A. 鼻腭管囊肿
B. 含牙囊肿
C. 正中囊肿
D. 球上颌囊肿
E. 以上均是

正确答案：B。含牙囊肿

解析：含牙囊肿属于牙源性颌骨囊肿。鼻腭管囊肿、正中囊肿、球上颌囊肿属于属发育性囊肿，是非牙源性颌骨囊肿。掌握“牙源性颌骨囊肿”知识点。